某医师开展心血管疾病的危险因素调查不属于个体因素的危险因素是
A. 遗传
B. 生活方式
C. 生物因素
D. 肥胖
E. 吸烟

正确答案：C。生物因素

解析：生物因素不属于个人危险因素范围内，而其他选项均属于个体因素范围内。掌握“环境卫生与职业卫生”知识点。